上下颌突联合不全形成
A. 横面裂
B. 斜面裂
C. 单侧唇裂
D. 下颌正中裂
E. 侧鼻裂

正确答案：A。横面裂

解析：本题考查面部发育异常。上下颌突联合不全形成横面裂（A对）。横面裂：由上下颌突联合不全形成。斜面裂（B错）：上颌突与侧鼻突未联合。单侧唇裂（C错）：一侧球状突和上颌突未融合或部分融合所致。下颌正中裂（D错）：两侧下颌突在中线处未融合。侧鼻裂（E错）：因侧鼻突与中鼻突之间发育不全，在鼻部形成纵行的侧鼻裂。